女，28岁。初孕妇，身高147cm。妊娠41周，规律宫缩12小时后孕妇紧张、乏力，BP140/90mmHg，胎心率140次分，枕左前位，先露S=-1，宫口开大9cm，羊水清亮，坐骨棘间径8cm。该患者正确的处理是
A. 徒手旋转胎头
B. 人工破膜加速胎头下降
C. 产钳助娩
D. 胎头吸引
E. 剖宫产

正确答案：E。剖宫产

解析：28岁初孕妇，身高147cm。妊娠41周，规律宫缩12小时后孕妇紧张、乏力，BP140/90mmHg，胎心率140次分，枕左前位，先露S=-1，宫口开大9cm，坐骨棘间径8cm（中骨盆平面狭窄Ⅲ级）。该患者正确的处理是剖宫产。中骨盆平面狭窄的处理：主要导致胎头俯屈及内旋转受阻，易发生持续性枕横位或枕后位。产妇多表现活跃期或第二产程延长及停滞、继发性宫缩乏力等。若胎头双顶径未达坐骨棘水平，或出现胎儿窘迫征象，应行剖宫产术结束分娩（E对）。